患者，女，21岁。春季旅游途中突感胸闷，呼吸困难，大汗。查体：口唇稍发绀，呼吸急促，听诊双肺布满干啰音，心率96次/分。既往有类似发作，有时休息后可缓解。应首先考虑的是
A. 过敏性休克
B. 支气管哮喘
C. 喘息性支气管炎
D. 心源性哮喘
E. 癔症

正确答案：B。支气管哮喘

解析：本例患者为青年女性，有反复胸闷、呼吸困难病史，休息后可缓解，此次于春季突发胸闷、呼吸困难，查体可见口唇发绀、呼吸急促，听诊时双肺布满干啰音，诊断应首先考虑的是支气管哮喘（B对）。过敏性休克（A错）为外界某些抗原性物质进入已致敏的机体所致，主要表现为面色苍白、四肢湿冷、脉搏细速等，部分患者可发生皮肤瘙痒、喉头水肿、支气管痉挛。喘息性支气管炎（C错）好发于婴幼儿，常继发于上呼吸道感染，主要表现为发热、气促，部分患者听诊时可有哮鸣音与粗湿啰音。心源性哮喘（D错）患者多有高血压、冠心病等病史和体征，主要表现为气促、端坐呼吸、阵发性咳嗽，常咳出粉红色泡沫痰，两肺可闻及广泛的湿啰音和哮鸣音。癔症（E错）是由精神因素作用于易病个体引起的精神障碍，主要表现有分离症状如分离性遗忘和转换症状如运动障碍。